属于Ⅲ型超敏反应性疾病的是
A. 过敏性鼻炎
B. 新生儿溶血
C. arthus反应
D. 接触性皮炎
E. 支气管哮喘

正确答案：C。arthus反应

解析：Ⅲ型超敏反应是由可溶性免疫复合物沉积于局部或全身多处毛细血管基底膜后，通过激活补体，并在中性粒细胞、血小板、嗜碱性粒细胞等效应细胞参与下，引起的以充血水肿、局部坏死和中性粒细胞浸润为主要特征的炎症反应和组织损伤。临床常见的Ⅲ型超敏反应性疾病有局部免疫复合物病（arthus反应（C对）和类arthus反应）和全身性免疫复合物病（血清病、链球菌感染后肾小球肾炎和类风湿性关节炎）。过敏性鼻炎（A错）、支气管哮喘（E错）为Ⅰ型超敏反应。新生儿溶血（B错）为Ⅱ型超敏反应。接触性皮炎为典型Ⅳ型超敏反应（D错）。